有关右心室的说法，错误的是
A. 位于右心房的左前下方
B. 是心腔最靠前的部分
C. 右房室口上有三尖瓣
D. 构成心的下缘和心尖
E. 室壁较左室壁薄

正确答案：D。构成心的下缘和心尖

解析：右心室位于右心房的左前下方（A对）。是心腔最靠前的部分（B对）。右房室口上有三尖瓣（C对）。心的下缘由右心室和心尖构成，心尖（D错，为本题正确答案）由左心室构成。右心室壁较左室壁薄（E对），只有左心室壁厚度的 1/3。